妊娠期高血压疾病肝风内动证的治疗方剂为
A. 正气天香散
B. 杞菊地黄丸
C. 半夏白术天麻汤
D. 羚角钩藤汤
E. 牛黄清心丸

正确答案：D。羚角钩藤汤

解析：妊娠期高血压病的肝风内动证主因素体阴虚，孕后阴血养胎，肾精愈亏，心肝失养，肝阳上亢，生风化火，风火相煽而发。治宜滋阴清热，平肝息风，方用凉肝息风，增液舒筋的羚角钩藤汤（D对）。妊娠期高血压病阴虚肝旺证的治疗方剂为杞菊地黄丸（B错）《医级》加天麻、钩藤、石决明；妊娠期高血压病脾虚肝旺证的治疗方剂为半夏白术天麻汤（C错）加钩藤、丹参；妊娠期高血压病痰火上扰证的治疗方剂为牛黄清心丸（E错）加竹沥、天竺黄、石菖蒲；正气天香散（A错）的功效是行气止痛，为理气药。